胎儿期保健
A. 保健的原则是对胎儿有利因素要保证，不利因素要尽量避免和减少
B. 主要保健重点是清理呼吸道，建立呼吸，保温，预防脐带断端、眼和皮肤感染，母乳喂养等
C. 约为10年，是身体和智力发展很快的时期。要加强营养，合理营养，避免儿童期肥胖的发生。避免女童发生外阴阴道炎
D. 是从儿童期末到性成熟期之间的一段生命时期，在此时期内身体和心理发生巨大的变化
E. 是妇女一生中生育和劳动生产的鼎盛时期

正确答案：A。保健的原则是对胎儿有利因素要保证，不利因素要尽量避免和减少

解析：本题考查胎儿期的保健原则。胎儿期的保健原则： 1.对胎儿保证有利因素的影响、避免和减少不利因素的影响（A对BCDE错）；保证孕母有足够的营养，忌烟酒。2.慎用药物，合理安排孕妇的生活和工作。3.注意孕期卫生，定期产前检查。胎盘屏障只免除部分细菌、病毒感染给胎儿的风险，并非所有病毒均可以屏蔽。